有关片剂质量检查的表述，不正确的是
A. 外观应色泽均匀、无杂斑、无异物
B. ≥0.30g的片重差异限度为±5.0%
C. 薄膜衣片的崩解时限是15min
D. 浸膏片的崩解时限是60min
E. 若A+1.45S＞15.0，则片剂的含量均匀度不合格

正确答案：C。薄膜衣片的崩解时限是15min

解析：本题考查片剂的质量检查。薄膜衣片的崩解时限为30min（C错，为本题正确答案），浸膏片的崩解时限是60min（D对）；片剂质量检查除崩解时限外还包括：色泽均匀、无杂物或异物（A对）；重量差异，平均片重或标示片重0.30g以下，重量差异限度为±7.5%；0.3g至0.30g以上，则重量差异限度±5%（B对）；含量均匀度，小剂量或单剂量的固体制剂、半固体制剂和每片含量符合标示量的程度，A+1.45S≤15.0，则供试品的含量均匀度符合规定；若A+1.45S＞15．0，则不符合规定（E对）；脆碎度等。